龈沟内壁上皮为
A. 非角化的复层鳞状上皮
B. 角化的复层鳞状上皮
C. 不全角化的复层上皮
D. 复层柱状上皮
E. 无钉突的复层上皮

正确答案：A。非角化的复层鳞状上皮

解析：本题考查牙龈上皮-沟内上皮。按照形态和功能划分，牙龈上皮分为3个区：口腔上皮、沟内上皮和结合上皮。其中沟内上皮又称龈沟内壁上皮，为牙龈沟的衬里上皮。龈沟内壁上皮为非角化的复层鳞状上皮（A对），沟内上皮有上皮钉突（E错），但缺乏颗粒层和角化层，且常有许多细胞呈水样变性。不全角化或角化的复层鳞状上皮（B错）见于口腔上皮，位于游离龈的顶端到外表面以及附着龈的表面。不全角化的复层上皮（C错）、复层柱状上皮（D错）均不是牙龈上皮的上皮结构。